可引起暴发的是
A. 接触传播
B. 诊疗手术传播
C. 水和食物传播
D. 各种药剂传播
E. 虫媒传播

正确答案：C。水和食物传播

解析：暴发（P8）是指在某一局部地区或集体单位中，短期内突然出现许多同一疾病的患者，大多是同一传染源或同一传播途径，如食物中毒、流行性感冒等。水和食物（C对）可引起疾病暴发流行，如1987-1988年上海甲肝大爆发。接触传播（A错）、诊疗手术传播（B错）、各种药剂传播（D错）、虫媒传播（E错）均引起散发性传播。